在一项接触粉尘与慢呼吸道疾病关系的病例对照研究中，如果不考虑吸烟的影响，其OR＝1，如果考虑吸烟对该关系的影响，进行分层分析，其OR＝2.03，吸烟对于接触粉尘与慢性呼吸道疾病关系的混杂偏倚为
A. 0.507
B. ﹣0.507
C. 1.03
D. ﹣1.03

正确答案：B。﹣0.507

解析：本题考查混杂偏倚的分层。如果不考虑吸烟的影响，其OR＝1，如果考虑吸烟对该关系的影响，进行分层分析，其OR＝2.03，吸烟对于接触粉尘与慢性呼吸道疾病关系的混杂偏倚为﹣0.507（B对ACD错）。